男，45岁，左膝关节肿胀伴积液，经穿刺抽出清亮液体。2天后出现寒战、高热、膝关节剧痛。查体：T39.5°C，膝关节肿胀并有压痛，实验室检查：WBC15.0×10⁹/L。左膝关节X线片见软组织肿胀、关节间隙增宽。此关节积液中主要的渗出成分依次是
A. 纤维素、脓液
B. 脓液、纤维素
C. 浆液、纤维素
D. 脓液、浆液
E. 浆液、脓液

正确答案：E。浆液、脓液

解析：患者左膝关节肿胀伴积液，经穿刺抽出清亮液体（浆液性），2天后出现寒战、高热、膝关节剧痛、肿胀并有压痛，WBC﹥10×10⁹/L（脓性）。左膝关节X线片见软组织肿胀、关节间隙增宽。最可能的诊断为化脓性关节炎。关节积液中主要的渗出成分依次是浆液、脓液（E对）。